我国新生儿败血症的病原体最常见的是
A. 变形杆菌
B. 铜绿假单胞菌
C. 幽门螺杆菌
D. 葡萄球菌
E. 克雷伯杆菌

正确答案：D。葡萄球菌